男，20岁。乏力、皮肤色素沉着1年余，经常感冒，食欲差，偶尔恶心、呕吐。查体：P84次/分，BP90/60mmHg。体型偏瘦，皮肤较黑，掌纹、乳晕、齿龈、颊黏膜等色素沉着明显，其余未见异常。最可能的诊断是
A. 结核
B. 原发性慢性肾上腺皮质功能减退症
C. 淋巴瘤
D. 先心病
E. 染色体异常

正确答案：B。原发性慢性肾上腺皮质功能减退症

解析：青年男性患者，乏力、皮肤色素沉着1年余，食欲差，偶有恶心、呕吐，体检出现血压偏低，皮肤、掌纹、乳晕、齿龈、颊黏膜等色素沉着（原发性慢性肾上腺皮质功能减退症的特征性表现），最可能的诊断为原发性慢性肾上腺皮质功能减退症（B对）。原发性慢性肾上腺皮质功能减退症虽可由肾上腺结核引起，但其多伴有肺结核或其他部位结核，典型表现有午后低热、乏力、盗汗、咳嗽、咯血等，且本例患者出现皮肤粘膜色素沉着等原发性肾上腺皮质功能减退症的特征性表现，因此不宜诊断为结核（A错）。淋巴瘤（C错）一般先以无痛性淋巴结肿大起病，多无皮肤粘膜色素沉着。先心病（D错）患者一般发病较早，体检会有心脏听诊异常，无皮肤粘膜色素沉着。染色体异常（E错）常于幼年发病，多有异常体貌特征。